关于直肠给药栓剂中药物吸收途径及其影响因素的说法，正确的有
A. 直肠中的脂溶性、非解离型的药物易吸收
B. 经直肠上静脉吸收的药物产生肝脏首过效应
C. 经肛门静脉吸收的药物可绕过肝脏进入大循环
D. 经肛门淋巴系统吸收的药物不产生肝脏首过效应
E. 油脂性基质栓剂中的水溶性药物释放快、易吸收

正确答案：A、B、C、D、E。直肠中的脂溶性、非解离型的药物易吸收；经直肠上静脉吸收的药物产生肝脏首过效应；经肛门静脉吸收的药物可绕过肝脏进入大循环；经肛门淋巴系统吸收的药物不产生肝脏首过效应；油脂性基质栓剂中的水溶性药物释放快、易吸收

解析：本题考查的是直肠给药栓剂中药物的吸收途径及影响因素。关于直肠给药栓剂中药物吸收途径及其影响因素的说法，正确的有直肠中的脂溶性、非解离型的药物易吸收（A对）、经直肠上静脉吸收的药物产生肝脏首过效应（B对）、肛门静脉吸收的药物可绕过肝脏进入大循环（C对）、经肛门淋巴系统吸收的药物不产生肝脏首过效应（D对）与油脂性基质栓剂中的水溶性药物释放快、易吸收（E对）。直肠给药栓剂中药物的吸收途径及影响因素：1.直肠给药栓剂中药物的吸收途径：肛门给药后，药物在直肠的吸收主要途径有：①经直肠上静脉吸收，由门静脉进入肝脏，再由肝脏进入大循环。②经直肠下静脉和肛门静脉吸收，由髂内静脉绕过肝脏，从下腔大静脉直接进入大循环。③经直肠淋巴系统吸收。2.影响直肠给药栓剂中药物吸收的因素：（1）生理因素：栓剂塞入直肠的深度影响药物的吸收，当栓剂塞入距肛门口2cm处时，其给药量的50%～70%可不经过门肝系统。另外，直肠有粪便存在、腹泻及组织脱水等均能影响药物从直肠部位的吸收。直肠液的pH约为7.4，且无缓冲能力，对弱酸弱碱性药物的吸收都有影响。（2）药物因素：药物的溶解度、脂溶性与解离度及粒径大小等均可影响药物的直肠吸收。难溶性药物宜减小粒径以增加溶出。脂溶性、非解离型的药物易吸收。（3）基质因素：水溶性药物分散在油脂性基质中，药物能较快释放或分散至分泌液中，故吸收较快。脂溶性药物分散于油脂性基质，药物需由油相转入水性分泌液中方能被吸收，吸收速度与药物的油水分配系数有关。表面活性剂能增加药物的亲水性，加速药物向分泌液中转移，有助于药物的释放。但表面活性剂的浓度不宜过高，以免在分泌液中形成胶束而使吸收下降。